既平肝潜阳，又清肝明目的药是
A. 礞石
B. 天麻
C. 钩藤
D. 全蝎
E. 石决明

正确答案：E。石决明

解析：本题考查的是石决明的功效。既平肝潜阳，又清肝明目的药是石决明（E对）。石决明：【功效】平肝潜阳，清肝明目。礞石（A错）：【功效】消痰下气，平肝镇惊。天麻（B错）：【功效】息风止痉，平抑肝阳，祛风通络。钩藤（C错）：【功效】息风止痉，清热平肝。全蝎（D错）：【功效】息风止痉，攻毒散结，通络止痛。